布洛芬最常见的不良反应是
A. 瑞夷综合征
B. 高铁血红蛋白血症
C. 胃肠道反应
D. 急性中毒可致肝坏死
E. 水、钠潴留

正确答案：C。胃肠道反应